下列有关精神检查的叙述中，正确的是
A. 纵向了解病人症状演变的过程
B. 检查病人当时的精神状态
C. 无自知力的精神病人在精神检查中所言均不可信
D. 精神检查时可与病人辩论其症状
E. 检查最好采用一问一答形式

正确答案：E。检查最好采用一问一答形式

解析：精神检查最好采用一问一答形式（E对）。横向诊断包括了精神科现代检查与精神活动的动态观察，横向了解病人症状演变的过程而非纵向诊断（A错）。